患者，女，28岁，体重80kg。12年前于颅脑外伤后出现癫痫全面强直-阵挛性发作，间断有失神发作，最初服用丙戊酸钠缓释片，后因效果不佳，陆续加用奥卡西平片、拉莫三嗪片，三药合用至今已3年；另外间断服用碳酸钙片、骨化三醇胶丸。丙戊酸钠的有效血药浓度为
A. 40～100㎍/mL
B. 4～12㎍/mL
C. 2.5～15㎍/mL
D. 10～20㎍/mL
E. 15～40㎍/mL

正确答案：A。40～100㎍/mL

解析：本题考查丙戊酸钠的有效血药浓度。丙戊酸钠的有效血药浓度为40～100㎍/mL（A对）。丙戊酸钠为抗癫痫药，用于原发性全面强直阵挛性发作；失神发作；肌阵挛-强直性发作；失张力发作；部分性发作。